治疗丹毒首选的拔罐法是
A. 留罐法
B. 走罐法
C. 留针拔罐法
D. 刺血拔罐法
E. 闪罐法

正确答案：D。刺血拔罐法

解析：该题主要考查拔罐的方法及其应用范围，可理解记忆。拔罐法具有通经活络、行气活血、消肿止痛、祛风散寒等作用。刺血有活血，清热等作用。